工业生产中以下哪一种肺尘埃沉着病最常见、进展快、危害严重
A. 石棉肺
B. 电焊工肺尘埃沉着病
C. 硅沉着病
D. 石墨肺尘埃沉着病
E. 水泥肺尘埃沉着病

正确答案：C。硅沉着病